依照《中华人民共和国价格法》，经营者销售、收购商品和提供服务，应按规定明码标价，并注明商品的
A. 品名、产地、规格、等级、计价单位、价格等
B. 品名、产地、规格、合格证、用途、价格等
C. 品名、生产厂家、规格、合格证、有效期限、价格等
D. 品名、生产厂家、合格证、质量保证期、价格等
E. 品名、产地、合格证、性能、制作成本、价格等

正确答案：A。品名、产地、规格、等级、计价单位、价格等